固体分散体中，药物与载体形成低共溶混合物时，药物的分散状态是
A. 分子状态
B. 胶态
C. 分子复合物
D. 微晶态
E. 无定形

正确答案：D。微晶态

解析：本题考查固体分散体。固体分散体中，药物与载体形成低共溶混合物时，药物的分散状态是微晶态（D对）。药物在载体材料中以分子、胶态、微晶或无定形状态分散。根据药物的分散状态，可以将固体分散体分为：1.低共熔混合物：药物与载体按适当比例混合，在较低温度下熔融，骤冷固化形成固体分散体，药物仅以微晶状态分散于载体中，为物理混合物；2.固体溶液：药物溶解于熔融的载体中，呈分子状态（A错）分散，为均相体系；3.共沉淀物：药物与载体材料以适当比例混合，形成的非结晶性无定形（E错）物。